可使丙氨酸氨基转移酶（ALT）升高的药品有
A. 伊曲康唑
B. 灰黄霉素
C. 琥乙红霉素
D. 联苯双酯
E. 氟伐他汀

正确答案：A、B、C、E。伊曲康唑；灰黄霉素；琥乙红霉素；氟伐他汀

解析：本题考查引起丙氨酸氨基转移酶升高的因素。伊曲康唑（A对）、灰黄霉素（B对）、琥乙红霉素（C对）、氟伐他汀（E对）均为可使丙氨酸氨基转移酶（ALT）升高的药物。常见可致ALT活力上升的其他药物主要有：①抗生素：四环素、利福平、林可霉素、克林霉素、羧苄西林、苯唑西林、氯唑西林、头孢呋辛、头孢美唑、头孢曲松、头孢哌酮、头孢他啶、拉氧头孢、头孢地嗪等均偶可引起血清AST或ALT升高。尤其红霉素类的酯化物可致肝毒性，常在用药后10～12d出现肝肿大、黄疸、AST或ALT升高等胆汁淤积表现。其中依托红霉素对肝脏的损害比红霉素大，主要表现为AST或ALT升高。②抗真菌药：氟康唑、伊曲康唑等可致血清AST一过性升高。灰黄霉素大剂量时有肝毒性，可见AST或ALT升高，个别人出现胆汁淤积性黄疸。酮康唑偶可发生肝毒性，表现为乏力、黄疸、深色尿、粪色白、疲乏、AST及ALT一过性升高，另有引起急性肝萎缩而致死的报道。③抗病毒药：阿昔洛韦、泛昔洛韦可致ALT及AST升高。④血脂调节药：应用羟甲戊二酰辅酶A还原酶抑制剂（他汀类血脂调节药）连续1年以上者有2%～5%可观察到无症状的AST及ALT异常。